位于上颌腭中缝的前端，为一卵圆形的软组织突起。义齿基托组织面在此处应作适当的缓冲处理的是
A. 切牙乳突
B. 上颌结节
C. 腭小凹
D. 颊棚区
E. 磨牙后垫

正确答案：A。切牙乳突

解析：本题考查种植覆盖全口义齿。切牙乳突（A对）位于上颌腭中缝的前端，上中切牙的腭侧，为一卵圆形的软组织突起。其下方为切牙孔，有鼻腭神经和血管通过，义齿基托组织面在此区域应做适当的缓冲处理，以免压迫切牙乳突产生疼痛。通常上中切牙唇面位于切牙乳突中点前8～10mm，两侧上颌尖牙牙尖顶的连线通过切牙乳突的中点。